舌下腺发育始于
A. 第4～5周
B. 第5～6周
C. 第6～7周
D. 第7～8周
E. 第8～9周

正确答案：D。第7～8周

解析：舌下腺在第7～8周开始发育，起源于颌舌沟近外侧的内胚层上皮，由10～20个分开的上皮芽发育而成。这些上皮芽向舌下区生长，各自形成小腺体，并分别保留各自的导管，开口于下颌下腺导管开口的外侧，但有时与下颌下腺主导管相通而不单独开口。掌握“唾液腺与颌骨的发育”知识点。